左侧舌下神经完全损伤
A. 有泌涎障碍
B. 舌的左侧半感觉障碍
C. 舌的左侧半不萎缩
D. 伸舌时舌尖偏向右侧
E. 伸舌时舌尖偏向左侧

正确答案：E。伸舌时舌尖偏向左侧

解析：一侧舌下神经核的神经元受损，可致病灶侧全部舌肌瘫痪，表现为伸舌时舌尖偏向病灶侧。所以左侧舌下神经完全损伤会致伸舌时舌尖偏向左侧（E对）。